《经脉别论》所述“毛脉合精”是指
A. 细小络脉相合
B. 毛脉均受谷气
C. 毛脉相会合
D. 气血相合
E. 以上均不是

正确答案：D。气血相合

解析：人体之精有广义、狭义之分，广义之精包括气、血、津液等人体一切精微物质；狭义之精专指生殖之精，原文是在说广义之精。精，贮藏于脏腑、形体、官窍之中，并流动于脏腑、形体、官窍之间，原文是指气血。肺主皮毛，心主血脉，肺藏气，心行血。毛脉合精指气血相合（D对）。